下列哪项不是经期延长阴虚血热证的主症
A. 月经持续八九日，量少、色红、质稠
B. 小腹疼痛拒按
C. 咽干口燥
D. 手足心热
E. 舌红少苔，脉细数

正确答案：B。小腹疼痛拒按

解析：实邪集聚，腹气不通，故小腹疼痛拒按（B对）。阴虚内热，热扰冲任，冲任不固，经血失约，故经行时间延长，阴虚水亏，故经量少，质稀，阴虚火旺，故色红（A错）。虚火灼津，津液亏耗，不能上承于咽而出现眼干口燥（C错）。阴血亏虚，虚火内扰，故出现手足心热（D错）。阴血亏虚，虚火上炎，故出现舌红，阴液亏损，不能上达于舌，故少苔，阴血亏虚，不能充盈脉管，故脉细，阴虚则内生虚火，故出现数脉（E错）。